起于中焦的经脉是
A. 手太阴肺经
B. 足少阳胆经
C. 足厥阴肝经
D. 足阳明胃经
E. 足太阳膀胱经

正确答案：A。手太阴肺经

解析：手太阴肺经起于中焦（A对）；手阳明大肠经起于食指桡侧端；足阳明胃经起于鼻翼旁（D错）；足太阴脾经起于足大趾内侧端；手少阴心经起于心中；手太阳小肠经起于小指尺侧端；足太阳膀胱经起于目内眦（E错）；足少阴肾经起于足小趾下；手厥阴心包经起于胸中；手少阳三焦经起于无名指尺侧端；足少阳胆经起于目外眦（B错）；足厥阴肝经起于足大趾爪甲后丛毛处（C错）。各经脉起止点及循行线需要考生记牢。